何者错误
A. 是男性尿道三部中最长的一段
B. 是尿道穿行于尿道海绵体内的一段
C. 在阴茎头处扩大形成尿道球部
D. 上端接尿道膜部，下端终止于尿道外口，兼有排尿及排精之功能
E. 又称前尿道

正确答案：C。在阴茎头处扩大形成尿道球部

解析：尿道海绵体部后端（C错，为本题正确答案）扩大为尿道球部，前端膨大为阴茎头。